女，36岁，发作性喘息，呼吸困难，再发加重1小时，既往氨茶碱可缓解，查体：精神萎靡，体温37.1℃，脉搏：128次/分，R：36次/分，鼻翼扇动，双肺呼吸音粗，可闻及广泛哮鸣音，参与该病的物质有
A. IL10
B. IL4
C. IL12
D. IL2
E. IL1

正确答案：B。IL4

解析：患者女，36岁，发作性喘息，呼吸困难，再发加重1小时，既往氨茶碱可缓解（可逆性气流受限），查体：精神萎靡，体温37.1℃，脉搏：128次/分，R：36次/分，鼻翼扇动，双肺呼吸音粗，可闻及广泛哮鸣音（支气管哮喘的特征性表现），结合患者的表现和辅助检查，提示为支气管哮喘，参与该病的物质有IL-4、IL-5、IL-13（B对）。